19世纪末所发明的革兰氏染色法，是由哪位细菌学家发明的
A. 英国细菌学家弗莱明
B. 美国细菌学家卡梅隆柯里
C. 英国细菌学家亚历山大弗莱明
D. 德国细菌学家罗伯特科赫
E. 丹麦细菌学家革兰氏

正确答案：E。丹麦细菌学家革兰氏

解析：由丹麦细菌学家革兰氏（H.C.J.Gram）于19世纪末所发明的革兰氏染色法，能将细菌分为革兰氏阳性菌与革兰氏阴性菌，至今仍被广泛应用于细菌的初步鉴别及指导选择抗生素治疗。掌握“细菌的特殊结构及检查方法”知识点。